结核性脑膜炎，抗结核强化治疗阶段应选择
A. 异烟肼+利福平+吡嗪酰胺
B. 异烟肼+利福平+乙胺丁醇
C. 异烟肼+利福平+链霉素
D. 异烟肼+利福平+链霉素+吡嗪酰胺
E. 异烟肼+利福平+链霉素+乙胺丁醇

正确答案：D。异烟肼+利福平+链霉素+吡嗪酰胺

解析：异烟肼对细胞内外的结核杆菌均有杀灭作用，无论脑膜有无炎症，均能迅速渗透到脑脊液中；利福平细胞内外的结核杆菌均有杀灭作用，不能通过正常脑膜，可通过部分炎症脑膜，是治疗结脑的常用药物；吡嗪酰胺主要杀灭酸性环境中生长在巨噬细胞内的结核杆菌，能够自由通过正常和炎性脑膜，是治疗结核性脑膜炎的重要抗结核药物；链霉素对吞噬细胞外的结核杆菌有杀灭作用，能够通过部分炎症血脑屏障；乙胺丁醇对结核分枝杆菌只有抑制生长的作用，对静止状态的细菌几乎无影响。综合以上药物特点，抗结核强化治疗阶段应选用异烟肼+利福平+链霉素+吡嗪酰胺（D对）联合进行治疗。